下列哪项不是高钙血症的病因？
A. 原发性甲状旁腺功能亢进
B. 慢性肾功能衰竭
C. 恶性肿瘤
D. VitD中毒
E. 肾上腺皮质功能减退

正确答案：B。慢性肾功能衰竭

解析：慢性肾功能衰竭（B错，为本题正确答案）时肾排磷减少，血磷升高导致血钙降低。PTH能通过促进成骨和溶骨的双重作用、增加肾近曲小管、远曲小管和髓袢上升段对Ca2＋的重吸收、促进小肠吸收钙升高血钙，甲状旁腺功能亢进（A对）时引起高钙血症。恶性肿瘤（C对）细胞可分泌破骨细胞激活因子，激活破骨细胞而致高钙血症。维生素D中毒（D对）可导致钙吸收过多。肾上腺皮质功能减退（E对）也可导致高钙血症。